男婴，8个月，自幼人工喂养，未补充维生素D制剂，近来出现多汗，烦躁，夜惊，查体：方颅，出牙延迟，串珠，诊断为佝偻病活动期，发病机制下列哪项是错误的
A. 尿磷排出增加
B. 血中钙磷乘积降低
C. 维生素D缺乏
D. 钙，磷在肠道吸收减少
E. 甲状腺代偿功能不足

正确答案：E。甲状腺代偿功能不足

解析：活动期（激期）除初期症状外，主要表现为骨骼改变和运动功能发育迟缓。骨骼改变往往在生长最快的部位最明显，故不同年龄有不同的骨骼表现。血生化及骨骼X线改变：血钙稍降低，血磷明显降低，钙磷乘积常低于30，碱性磷酸酶明显增高。X线检查干骺端临时钙化带模糊或消失，呈毛刷样，并有杯口状改变；骺软骨明显增宽，骨骺与干骺端距离加大；骨质普遍稀疏，密度减低，可有骨干弯曲或骨折。掌握“维生素D缺乏性佝偻病”知识点。